患者，男。餐后痛症状3年，现空腹突发上腹剧痛，放射至背部。最可能的诊断是
A. 急性胆囊炎
B. 急性胰腺炎
C. 胃十二指肠溃疡穿孔
D. 脾破裂
E. 胰头占位

正确答案：C。胃十二指肠溃疡穿孔

解析：男性患者，餐后痛症状3年，提示患者有胃十二指肠溃疡（胃十二指肠溃疡患者病史可达数年或十余年；主要症状为上腹部疼痛或不适，疼痛呈周期性，节律性发作，如饥饿痛或餐后痛）。现患者空腹突发上腹剧痛，放射至背部，提示患者出现穿孔后腹膜炎（胃十二指肠溃疡急性穿孔，常表现为突发上腹部剧痛，呈“刀割样”腹痛迅速波及全腹。胃十二指肠内容物流入腹腔产生化学性刺激，疼痛可放射至背部并易诱发化脓性腹膜炎）。综合该患者的病史、临床症状，该患者诊断考虑为胃十二指肠溃疡穿孔（C对）。急性胆囊炎（A错）表现为右上腹绞痛或持续性疼痛伴阵发加剧疼痛向右肩放射，伴畏寒发热。急性胰腺炎（B错）的腹痛发作一般不如溃疡急性穿孔者急骤，腹痛多位于上腹部偏左并向背部放射。脾破裂（D错）患者多有外伤史，主要表现为腹腔内（腹膜后）出血，表现为面色苍白、脉率加快、脉搏细弱、血压不稳等血容量不足的症状，严重者可出现休克，脾破裂患者腹痛为持续性，但一般不剧烈，腹膜炎刺激症状也不严重。胰头占位（E错）最常见的首发症状多为上腹痛，多为隐痛、钝痛、胀痛，最重要的临床表现为黄疸。